细菌在哪个时期中最易出现变异
A. 迟缓期
B. 对数期
C. 稳定期
D. 衰亡期
E. 以上均可

正确答案：C。稳定期

解析：处于稳定期的细菌形态和生理性状常有改变。产生芽孢（胞）、抗生素及外毒素等代谢产物，多在稳定期。掌握“细菌的生理”知识点。